患者，女，51岁，体检时发现血160/105mmHg，量试验餐后2小时血糖为9.56mmol/L（参考范围＜7.8mmol/L），甘油三酯0.52mmol/L（参考范围0.56～1.70mmol/L），总胆固醇6.26mmol/L（参考范围＜0.2mmoL），低密度脂蛋白胆固醇4.85mmol/L（参考范围2.1～3.1mmol/L），高密度脂蛋白胆固醇1.20mmol/L（参考范围1.2～1.65mmol/L，肌酐60㎛ol/L（参考范围45～84㎛ol/M），蛋白尿：++。临床诊断为高血压病、高脂血症、糖耐量异常。应告知该患者用药过程中可能出现的不良反应是
A. 踝关节水肿
B. 牙龈出血
C. 心悸
D. 便血
E. 干咳

正确答案：E。干咳

解析：本题考查药物不良反应。ACEI类药物最常见不良反应为持续性干咳（E对），其他不良反应有低血压、皮疹，偶见血管神经性水肿及味觉障碍。